患者，女，18岁。感冒后身热不甚，干咳无痰，咽干口渴，右脉数大。治疗应首选
A. 杏苏散
B. 泻白散
C. 桑菊饮
D. 桑杏汤
E. 止嗽散

正确答案：D。桑杏汤

解析：本题考查常见的病症的辩证、处方。题中患者感冒后身热不甚，干咳无痰，咽干口渴，右脉数大，证属外感温燥证。杏苏散为治燥剂，具有轻宣凉燥，理肺化痰之功效。主治外感凉燥证。恶寒无汗，头微痛，咳嗽痰稀，鼻塞咽干，苔白脉弦（A错）。泻白散为清热剂，具有清脏腑热，清泻肺热，止咳平喘之功效。主治肺热喘咳。气喘咳嗽，皮肤蒸热，日晡尤甚，舌红苔黄，脉细数（B错）。桑菊饮为解表剂，具有辛凉解表，疏风清热，宣肺止咳之功效。主治风温初起，咳嗽，身热不甚，口微渴，苔薄白，脉浮数者（C错）。桑杏汤为治燥剂，具有清宣温燥，润肺止咳之功效。主治外感温燥证。身热不甚，口渴，咽干鼻燥，干咳无痰或痰少而粘，舌红，苔薄白而干，脉浮数而右脉大者（D对）。止嗽散为解表剂，具有辛温解表，宣肺疏风，止咳化痰之功效。主治外感咳嗽，症见咳而咽痒，咯痰不爽，或微有恶风发热，舌苔薄白，脉浮缓（E错）。